中医外科成为独立专科的年代
A. 商代
B. 周代
C. 秦代
D. 汉代
E. 明代

正确答案：B。周代

解析：我国医事分科最早始于周代，同时也有了疡医，即相当于现代的外科医生（B对）。殷商时期出土的甲骨文已有外科病名的记载，但尚未有医事分科（A错）。秦代官方文件中记录关于疠疡的诊断要点及处置刑律（C错）。汉代的医家如张仲景、华佗等为外科学的发展作出了巨大贡献（D错）。明清时期，中医外科学进入自身发展的黄金时期（E错）。